患者，男，因哮喘就诊。医生开具丙酸氟替卡松吸入气雾剂控制哮喘症状，建议使用2周，换用激素药物会产生全身性糖皮质激素副作用，就此咨询药师。丙酸氟替卡松作用的受体属于
A. G蛋白偶联受体
B. 配体门控离子通道受体
C. 酪氨酸激酶受体
D. 细胞核激素受体
E. 生长激素受体

正确答案：D。细胞核激素受体

解析：本题考查丙酸氟替卡松。丙酸氟替卡松作用的受体属于细胞核激素受体（D对）。丙酸氟替卡松是一种吸入性糖皮质激素，其作用机制为：皮质激素进入血液循环后，一般与血中特异的蛋白质-皮质激素运载蛋白形成可逆的非共价键复合物，使激素免受破坏，并可调节血中游离甾体的浓度，从而调控作用于靶细胞的激素的有效浓度。根据通行的假说，进入细胞的皮质激素也如其它甾体激素一样，与细胞内特异受体相结合，经激活后结合细胞核，影响染色质的转录作用，诱导新的蛋白质合成，表现为细胞功能的变化。